患者，男，50岁。右颜面部红肿疼痛伴发热2天，皮色鲜红，色如涂丹，压之褪色，扪之灼手，边界清楚，触痛明显。大便2日未行。治疗应首选
A. 萆薢渗湿汤加减
B. 五味消毒饮加减
C. 普济消毒饮加减
D. 黄连解毒汤加减
E. 犀角地黄汤加减

正确答案：C。普济消毒饮加减

解析：丹毒是患部皮肤突然发红成片、色如涂丹的急性感染性疾病。临床特点为病起突然，恶寒发热，局部皮肤忽然变赤，色如丹涂脂染，焮热肿胀，边界清楚，迅速扩大，数日内可逐渐痊愈，但容易复发。该患者发于头面部，以颜面红肿疼痛，皮色鲜红，色如涂丹，边界清楚为主要临床表现，诊断为丹毒，发病部位以颜面为主，又称抱头火丹，为风热毒蕴证，用普济消毒饮加减（C对）。萆薢渗湿汤合五神汤加减可用于湿热毒蕴证（A错）。五味消毒饮加减不是本病的治疗方药（B错）。黄连解毒汤合犀角地黄汤加减可用于胎火毒蕴证（DE错）。